柜台药或大众药
A. 处方药
B. 非处方药
C. 两者都是
D. 两者都不是

正确答案：B。非处方药

解析：本题考查非处方药。柜台药或大众药是非处方药（B对）。非处方药是指由国家药品监督管理局公布的，不需要凭执业医师和执业助理医师处方，消费者可以自行判断、购买和使用的药品。非处方药是方便消费者自我保健、治疗的药品，消费者应详细了解其治疗功效。因此，非处方药可以在大众媒体上进行广告宣传。处方药（A错）是指凭执业医师和执业助理医师处方方可购买、调配和使用的药品。